辨别寒热真假时，真象常出现于
A. 体表
B. 四肢
C. 面色
D. 舌、脉
E. 背部

正确答案：D。舌、脉

解析：某些疾病在病情的危重阶段，可出现一些与疾病本质相反的假象，如里热炽盛的患者，可出现四肢厥冷、脉迟的假寒症状，阳虚阴寒内盛的患者可出现自觉发热、面色发红、口渴等假热症状，故（ABC错）。舌脉是疾病内在气血虚实、阴阳盛衰、脏腑功能强弱的客观反映，能较客观准确的反映病情，可作为诊断疾病、了解病情和辨证的重要依据（D对）。